游走性舌炎的病损形态常表现为
A. 蝶形
B. 菱形
C. 盘形
D. 蔓延性
E. 地图形

正确答案：E。地图形

解析：地图舌是一种浅层的慢性剥脱性舌炎，主要出现在舌背，有时也见于舌缘、舌腹、舌尖。病损的形态表现为圆或椭圆的红斑，可单个或多个，并能很快扩大或融合，融合后常类似地图的边界，故称地图舌。由于其形态和位置多变，故又名游走性舌炎。掌握“地图舌、沟纹舌及舌乳头炎”知识点。